小儿重症手足口病的病原体多为
A. 埃可病毒
B. 人疱疹病毒6型
C. 轮状病毒
D. 肠道病毒71型
E. 柯萨奇病毒A组16型

正确答案：D。肠道病毒71型

解析：手足口病主要表现为发热、手足臀部皮肤的皮疹和口黏膜溃疡等，病原主要为肠道病毒，我国以柯萨奇病毒A组16型和肠道病毒71型多见，其中肠道病毒71型（D对）重症率和病死率均高于柯萨奇病毒A组16型（E错）。轮状病毒（C错）（P252）是引起寒冷季节婴幼儿腹泻最常见病毒，埃可病毒（A错）也是引起婴幼儿腹泻的病原之一；人疱疹病毒6型（B错）（P197 表10-1）是幼儿急疹的病原体。